能补肾助阳、润肠通便的药是
A. 海马
B. 鹿茸
C. 淫羊藿
D. 补骨脂
E. 肉苁蓉

正确答案：E。肉苁蓉

解析：本题考查肉苁蓉的功效。能补肾助阳、润肠通便的药是肉苁蓉（E对）。肉苁蓉【功效】补肾阳，益精血，润肠通便。海马（A错）【功效】补肾助阳，活血散结，消肿止痛。鹿茸（B错）【功效】壮肾阳，益精血，强筋骨，调冲任，托疮毒。淫羊藿（C错）【功效】补肾阳，强筋骨，祛风湿。补骨脂（D错）【功效】补肾壮阳，固精缩尿，温脾止泻，纳气平喘。